拔除上颌牙时，患者体位应是
A. 头部应稍后仰，张口时上颌（牙合）平面与地面平行
B. 头部应稍后仰，张口时上颌（牙合）平面与地面成45°
C. 头部应稍后仰，张口时上颌（牙合）平面与地面成90°
D. 头部应稍后仰，张口时上颌（牙合）平面与地面成60°
E. 头部应稍后仰，张口时上颌（牙合）平面与地面成30°

正确答案：B。头部应稍后仰，张口时上颌（牙合）平面与地面成45°

解析：患者体位：患者头部应稍后仰，使上颌（牙合）平面约与地面成45°角，患者的上颌与术者的肩部约在同一水平，便于上臂用力。掌握“牙拔除术前准备、器械、心血管及拔牙愈合过程”知识点。